分布于上87654│45678腭侧牙龈及黏骨膜的神经是
A. 下牙槽神经
B. 上牙槽中神经
C. 上牙槽后神经
D. 鼻腭神经
E. 腭前神经

正确答案：E。腭前神经

解析：腭前神经麻醉区域及效果：同侧磨牙、前磨牙腭侧的黏骨膜，牙龈及牙槽骨。注意行腭大孔注射时，注射麻药不可过多，注射点不可偏后，以免同时麻醉腭中、腭后神经，引起软腭、悬雍垂麻痹而致恶心或呕吐。掌握“颌面部常用局麻法及牙拔除的麻醉选择”知识点。